患者，女，60岁，初戴全口义齿，医师检查发现在正中（牙合）接触时，咬合接触点少若检查时发现侧方（牙合）时平衡侧有接触，工作侧不接触，应调磨的位置是
A. 平衡侧上后牙颊尖舌斜面或下后牙颊尖颊斜面
B. 平衡侧上后牙颊尖颊斜面或下后牙颊尖舌斜面
C. 平衡侧上后牙舌尖舌斜面或下后牙舌尖颊斜面
D. 平衡侧上后牙舌尖颊斜面或下后牙颊尖舌斜面
E. 平衡侧上后牙舌尖颊斜面或下后牙舌尖颊斜面

正确答案：D。平衡侧上后牙舌尖颊斜面或下后牙颊尖舌斜面

解析：本题考查全口义齿初戴。侧方（牙合）干扰的选磨：平衡侧的（牙合）干扰发生在上后牙舌尖的颊斜面和下后牙颊尖的舌斜面之间。在调磨的时候应该调磨平衡侧上后牙舌尖颊斜面或下后牙颊尖舌斜面（D对）。